男，20天。面色苍白7天就诊。血常规：Hb50g/L。该患儿属于
A. 中度贫血
B. 极重度贫血
C. 重度贫血
D. 正常
E. 轻度贫血

正确答案：B。极重度贫血

解析：20天的患儿，还处于新生儿期，该新生儿Hb50g/L（＜60g/L）属于极重度贫血（B对）。中度贫血的Hb值应该为～90g/L（A错）。重度贫血的Hb值应给为＜60g/L（C错）。我国小儿血液会议（1989年）建议：血红蛋白在新生儿期＜145g/L为贫血（D错）。轻度贫血的Hb值应该为144～120g/L（E错）。